上述反佐药涵义的表述，正确的是
A. 针对主病或主证起主要治疗作用
B. 针对重要的兼病或兼证起主要治疗作用
C. 针对次要兼证起直接治疗作用
D. 消减或制约君、臣药的毒性和峻烈之性
E. 防止病重邪甚时药病格拒

正确答案：E。防止病重邪甚时药病格拒

解析：该题考查方剂组成的基本结构。针对主病或主证起主要治疗作用的为君药（A错）。针对重要的兼病或兼证起主要治疗作用为臣药（B错）。针对次要兼证起直接治疗作用为佐助药（C错）。消减或制约君、臣药的毒性和峻烈之性的为佐制药（D错）。防止病重邪甚时药病格拒的为反佐药（E对）。